乳酸脱氢酶同工酶有
A. 2种
B. 3种
C. 4种
D. 5种
E. 6种

正确答案：D。5种

解析：乳酸脱氢酶同工酶有5种（D对），即LDH1（H₄）、LDH2（H₃M）、LDH3（H₂M₂）、LDH4（HM₃）、LDH5（M₄）。肌酸激酶的同工酶有3种，即CK1（BB）、CK2（MB）CK3（MM）。